血管外溶血时，红细胞破坏的最主要的场所是
A. 心脏
B. 脾
C. 肝
D. 肾
E. 骨髓

正确答案：B。脾

解析：衰老的红细胞由于变形能力减退，脆性增高，被脾和骨髓等单核-巨噬细胞系统吞噬消化，称为血管外破坏。单核-巨噬细胞系统包括血液中的单核细胞和组织中固定或游走的巨噬细胞，脾脏是机体最大的免疫器官，含有大量的淋巴细胞和巨噬细胞，故血管外溶血时，红细胞破坏最主要的场所是脾脏（B对）。骨髓（E错）不仅是造血器官也是免疫器官，参与红细胞的破坏，但其最主要的功能是造血；肝（C错）、肾（D错）等组织器官仅含有少量的吞噬细胞，不是红细胞破坏的主要场所；心脏（A错）是血液泵，不参与血管外溶血。